女，45岁，G4P2。月经规律，白带增多半年，性交后阴道流血2个月。近3年未体检。妇科检查发现宫颈重度糜烂状，接触性出血（+），子宫附件未见明显异常。宫颈活检组织病理报告为宫颈鳞状细胞癌，浸润深度为7mm。该患者的临床分期是
A. ⅠA₂
B. ⅠB₁
C. ⅠB₂
D. ⅠA₁
E. ⅡA

正确答案：B。ⅠB₁

解析：中年女性患者，宫颈活检组织病理报告为宫颈鳞状细胞癌，浸润深度为7mm。综合患者的症状、体征和辅助检查，初步诊断为宫颈鳞状细胞癌ⅠB₁期（B对）：肉眼可见癌灶≦4cm。ⅠA₂（A错）：间质浸润深度＞3mm且＜5mm，宽度≦7mm。ⅠB₂（C错）：肉眼可见癌灶＞4cm。ⅠA₁（D错）：间质浸润深度≦3mm，宽度≦7mm。ⅡA（E错）：肿瘤侵犯阴道上2/3，无明显宫旁浸润。